含有半胱氨酸结构，可降低痰液黏滞性的药物是
A. 盐酸氨溴索
B. 羧甲司坦
C. 右美沙芬
D. 磷酸苯丙哌林
E. 磷酸可待因

正确答案：B。羧甲司坦

解析：本题考查祛痰药羧甲司坦。羧甲司坦（B对）含有半胱氨酸结构，可调节支气管腺体的分泌，降低痰液黏滞度，而达到祛痰的效果。氨溴索（A错）是黏痰溶解剂，不含半胱氨酸结构；右美沙芬（C错）是具有苯吗喃基本结构的中枢镇咳药；磷酸苯丙哌林（D错）主要通过阻断肺-胸膜的牵张感受器产生的肺-迷走神经反射，用于各种原因引起的干咳；可待因（E错）是具有芳香醚结构的中枢神经镇咳药。